胸锁乳突肌
A. 位于颈部深层
B. 起自胸骨的锁骨端
C. 损伤后出现斜颈
D. 双侧收缩使头前屈
E. 一侧收缩使面部转向同侧

正确答案：C。损伤后出现斜颈

解析：胸锁乳突肌位于颈部浅层，而非深层（A错）；起自胸骨的胸骨端，而非锁骨端（B错）；一侧收缩使头向同侧倾斜，而非使面部转向同侧（E错），故损伤后出现斜颈（C对），两侧收缩使头后仰，而非使头前屈（D错）。